男，23岁。主诉自高中毕业后越来越不能与人发生近距离的接触。近一年来发展为与熟人甚至自己的父母说话也紧张，且一说话就脸红心跳，总怕说错话。对于该患者，心理治疗首选的方法为
A. 生物反馈
B. 自由联想
C. 系统脱敏
D. 催眠治疗
E. 梦的分析

正确答案：C。系统脱敏

解析：系统脱敏疗法（C对）又称交互抑制法，这种方法主要是诱导求治者缓慢地暴露出导致神经症焦虑、恐惧的情境，并通过心理的放松状态来对抗这种焦虑情绪，从而达到消除焦虑或恐惧的目的。文中的男生害怕与他人接触，面对与他人的交往而恐惧紧张不已，这属于典型的神经焦虑恐惧的表现，可以采取系统脱敏法逐渐消除他的恐惧感。自由联想（P205）（B错）是指在治疗过程中，医生通过鼓励病人回忆从童年起所遭遇到的一切经历或精神创伤与挫折，从中发现那些与病情有关的心理因素。梦的分析（P206）（E错）主要是指治疗者可以通过梦观察病人是如何思考，感受，分析，防御和阻抗来帮助病人了解自己的内心活动。催眠治疗（P228）（D错）是运用暗示的方法使患者进入一种特殊的意识状态，控制患者的身心活动，从而解除和治疗患者的心身问题的心理疗法。一般适用于抑郁症，心身疾病和功能性障碍等，但由于其疗效很大程度取决于患者的催眠感受性和参与度，局限性较大。